临床判断休克的主要指征不包括
A. 血压
B. 肺活量
C. 机体温度
D. 皮肤色泽
E. 尿量

正确答案：B。肺活量

解析：临床判断休克的主要指征包括：血压、脉搏、皮肤色泽与温度、尿量等，休克早期心率的变化是重要的指征，正常成人的心率上限如达到120次/分钟，结合四肢皮肤的变化，是早期诊断休克较可靠的指征。掌握“口腔颌面部创伤急救”知识点。